牙体缺损的病因临床上容易忽视的是
A. 龋病
B. 牙隐裂
C. 酸蚀症
D. 发育畸形
E. 楔状缺损

正确答案：B。牙隐裂

解析：一般来说，临床上容易忽视的是隐裂牙，多见于后牙。其表面有不易发现的裂纹，早期可出现牙本质敏感症状，如遇到较大的（牙合）力或外力，则极易产生牙折。此外，对于大面积充填的无髓牙，正常的咬合力也可导致牙折。掌握“牙体缺损病因及影响”知识点。